下列有关执业药师在日常药学服务中为保证合理用药所采取具体措施的说法，错误的是
A. 需要熟练掌握并始终学习中医药理论和基本知识特别是临床中药学
B. 在回答患者咨询问题时应先全面了解其病史、病情资料准确掌握其病证后再回答
C. 在进行发药交待时对育龄期妇女的身体状况只需明确其是否妊娠即可
D. 在采购与调剂饮片时要确保药品品种不混乱、药用部位准确、炮制适当
E. 对患者进行用药教育时应告知患者关注偏性突出、作用强烈中药的正确使用

正确答案：C。在进行发药交待时对育龄期妇女的身体状况只需明确其是否妊娠即可

解析：本题考查的是保证合理用药的主要措施。执业药师在建议临床用药时，应详细辨析患者的体质、年龄、性别和生活习惯等（C错，为本题正确答案）。保证合理用药应参辨患者的身体状况：执业药师在建议临床用药时，应详细辨析患者的体质、年龄、性别和生活习惯等，将其作为选用药物及制定用药方案时的重要依据，投以针对病情及患者具体情况的最佳药物，确定合理给药剂量，万不能疏忽大意。保证合理用药应努力研习中医药学（A对）：熟练地掌握中医药理论和基本知识，是合理用药的先决条件。所以，每一个执业药师都要始终将学习中医药基本知识和研究中医药理论，放在业务工作的首位，特别是中药药性理论与常用中药的性能特点、功效主治、配伍应用、用量用法及使用注意等临床中药学的内容。此外，还要区别中药的有毒与无毒，慎用有毒特别是有剧毒的中药，并当严格炮制，谨守用法用最，以免发生中毒。保证合理用药应选择质优的饮片（D对）：中药饮片因受品种、产地、药用部位、炮制及贮藏等的影响，质量良莠不齐，致使疗效及对人体的毒副作用有别。每一个执业药师，要时刻把好药材与饮片的质量关。在采买与调剂时，一定要选择质优效佳的饮片，不能选择质劣效差的饮片。要认真做到品种混乱者不用，出产于被污染环境中者不用，药用部位失准者不用，违规炮制者不用，霉烂变质者不用。给患者使用的中药和中成药，应是质量最佳、疗效最好的饮片。用药教育是通过收集与患者用药相关的信息，对患者进行合理用药知识的宣教和指导，介绍药物和疾病的知识，增强患者对相关知识的认知和了解，从而提高患者的用药依从性，减少不良反应，降低用药错误的发生率（E对）。